降压作用平稳、持久的钙离子通道阻滞药是
A. 硝苯地平
B. 尼卡地平
C. 尼索地平
D. 尼群地平
E. 拉西地平

正确答案：E。拉西地平